大连接体的主要作用是
A. 连接义齿各部分成一整体
B. 保护口腔内软组织
C. 提高义齿舒适性
D. 增加义齿固位及稳定
E. 形态美观

正确答案：A。连接义齿各部分成一整体

解析：大连接体的作用：连接义齿各部分成一整体，传递和分散（牙合）力至基牙和邻近的支持组织，以减少基牙在功能状态时所承受的扭力和负荷；可减小基托面积，并可增加义齿的强度。掌握“局部义齿人工牙及基托”知识点。